女，29岁，体健。主诉：近3个月刷牙牙龈易出血，且咀嚼较硬食物时牙龈出血。应做如下检查，除外
A. 口腔卫生状况
B. （牙合）力测定
C. 牙龈炎症
D. 附着丧失
E. 探诊深度

正确答案：B。（牙合）力测定

解析：本题考查牙周组织检查。女，29岁，体健。主诉：近3个月刷牙牙龈易出血，且咀嚼较硬食物时牙龈出血。应做如下检查，除外（牙合）力测定（B错，为本题的正确答案）。（牙合）力测定主要用于检查牙周炎患者（牙合）力大小，以反映其牙周组织的健康状况，该病例中并未确诊患牙有牙周炎，故不需行（牙合）力测定。根据病例描述，患者近3个月刷牙牙龈易出血，且咀嚼较硬食物时牙龈出血，初步考虑是由于牙周组织的炎症导致牙龈出血，故应该检查：1.口腔卫生状况（A对），以了解患者口腔内菌斑、软垢、牙石和色渍沉积情况；2.牙龈炎症（C对）情况，以了解牙龈是否有炎症，以及炎症的严重程度；3.附着丧失（D对），检查患牙有没有附着丧失，有利于确定是否有牙周病；4.探诊深度（E对）有利于初步了解牙周支持组织丧失情况。以上4项综合起来，可以初步确定患者牙龈炎症严重程度，牙龈炎症是由单纯的牙龈炎还是牙周炎导致的，因此都有必要检查。